《内经》阴阳之征兆是
A. 天地
B. 男女
C. 上下
D. 水火
E. 左右

正确答案：D。水火

解析：“水火者，阴阳之征兆也”（《素问·阴阳应象大论》）。中医学以水火作为阴阳的征象，水为阴，火为阳，反映了阴阳的基本特性。如水性寒而就下，火性热而炎上。其运动状态，水比火相对的静，火较水相对的动，寒热、上下、动静，如此推演下去，即可以用来说明事物的阴阳属性。划分事物或现象阴阳属性的标准是：凡属于运动的、外向的、上升的、温热的、明亮的、功能的属于阳的范畴；静止的、内在的、下降的、寒凉的、晦暗的、物质的属于阴的范畴。由此可见，阴阳的基本特性，是划分事物和现象阴阳属性的依据（D对）。